口服液体制剂中常用的潜溶剂是
A. 聚山梨酯80
B. 乙醇
C. 苯甲酸
D. 乙二胺
E. 羟苯乙酯

正确答案：B。乙醇

解析：本题考查潜溶剂。口服液体制剂中常用的潜溶剂是乙醇（B对）；聚山梨酯80（A错）为增溶剂；苯甲酸（C错）、乙二胺（D错）为助溶剂；羟苯乙酯（E错）为防腐剂。